女性，82岁，牙列缺失，牙槽嵴狭窄，全口义齿修复后咀嚼效率低，其原因不可能是
A. 年龄过大
B. 义齿固位较差
C. 垂直距离过低
D. 咬合接触点少
E. 人工牙过小

正确答案：A。年龄过大

解析：本题考查全口义齿戴入后问题及处理。全口义齿修复后咀嚼效率的高低与牙槽骨的丰满度、义齿固位力（B对）、义齿垂直距离的高低（C对）、咬合接触面积（D对）、人工牙的型号大小（E对）均有关，而与患者的年龄无直接相关联系（A错，为本题正确答案）。